足三阴经在内踝上8寸以上肢体部的分布规律是
A. 厥阴在前太阴在中少阴在后
B. 少阴在前厥阴在中太阴在后
C. 厥阴在前少阴在中太阴在后
D. 太阴在前厥阴在中少阴在后
E. 太阴在前少阴在中厥阴在后

正确答案：D。太阴在前厥阴在中少阴在后

解析：十二经脉在四肢部的分布规律：手经行于上肢，足经行于下肢；阴经行于内侧面，阳经行于外侧面。按正立姿势，两臂自然下垂拇指向前的体位描述：手足阴经为太阴在前缘、厥阴在中线、少阴在后缘；手足阳经为阳明在前缘、少阳在中线、太阳在后缘；足厥阴肝经有例外，即内踝尖上八寸以下为厥阴行于前，太阴行于中，少阴仍在后。所以足三阴经在内踝上8寸以上肢体部的分布规律是太阴在前、厥阴在中、少阴在后（D对）。